不属于介水传染病的有
A. 霍乱
B. 伤寒
C. 乙肝
D. 血吸虫病
E. 沙眼

正确答案：C。乙肝

解析：本题考查介水传染病的相关内容。介水传染病是指通过饮用或接触病原体污染的水而传播的疾病。其发生原因有二：①水源受病原体污染后，未经妥善处理和消毒即供居民饮用；②净化消毒后的饮用水在输配水和贮水过程中，由于管道渗漏、出现负压等原因，重新被病原体污染。霍乱（A对）、伤寒（B对）、血吸虫病（D对）、沙眼（E对）均属于介水传染病。乙肝（C错，为本题正确答案）不属于介水传染病。